短期饥饿时，血糖浓度的维持主要靠
A. 肌糖原分解
B. 肝糖原分解
C. 酮体转变成糖
D. 糖异生作用
E. 组织中葡萄糖的利用

正确答案：B。肝糖原分解

解析：短期饥饿时，血糖浓度的维持主要靠：肝糖原分解。长期饥饿时，血糖浓度的维持主要靠糖异生维持血糖，其他选项不是在饥饿时维持血糖浓度的主要来源。掌握“糖原与糖异生”知识点。